卫生监督人员在对用人单位监督检查时，对职业病防治措施和制度是否健全、职业病危害是否告知、职业病防护措施和用品提供和使用、职业培训是否按期进行等方面进行了检查，这种监督称为
A. 职业危害监督
B. “四同时”
C. 预防性危害监督
D. 经常性职业卫生监督
E. 卫生行政监督

正确答案：D。经常性职业卫生监督